容易引起精神依赖的药物，除外
A. 巴比妥类
B. 氨基糖苷类
C. 吗啡
D. 哌替啶
E. 苯丙胺

正确答案：B。氨基糖苷类